患者，女，28岁，近一个月出现阴道分泌物增多，阴道检查时发现大量泡沫样分泌物，经验治疗首选的药物是
A. 甲硝唑
B. 咪康唑
C. 头孢曲松钠
D. 青霉素钠
E. 克拉霉素

正确答案：A。甲硝唑

解析：本题考查阴道炎治疗药。阴道检查发现大量泡沫样分泌物可诊断为滴虫性阴道炎，因此治疗首选甲硝唑（A对）。